下列清热药中，兼有止血功效的是
A. 穿心莲
B. 秦皮
C. 白鲜皮
D. 熊胆
E. 马齿苋

正确答案：E。马齿苋

解析：马齿苋的功效是清热解毒，凉血止血，止痢。本品味酸而寒，入肝经血分，有清热凉血，收敛止血之效（E对）。穿心莲（A错）的功效是清热解毒，凉血，消肿，燥湿。秦皮（B错）的功效是清热燥湿，收涩止痢，止带，明目。白鲜皮（C错）的功效是清热燥湿，祛风解毒。熊胆（D错）的功效是清热解毒，熄风止痉，清肝明目。